因口腔内瘢痕组织对义齿修复的固位和稳定有影响时，应考虑
A. 观察
B. 不予处理
C. 义齿缓冲
D. 进行修整
E. 重新制作义齿

正确答案：D。进行修整

解析：瘢痕组织的修整：口腔内如有瘢痕组织，当对义齿的固位稳定有影响时，可考虑予以修整。掌握“修复前准备”知识点。